以下病机中是以阴阳失调来阐释实热或实寒的是
A. 阴阳偏盛
B. 阴阳格拒
C. 阴阳偏衰
D. 阴阳互损
E. 阴阳离决

正确答案：A。阴阳偏盛

解析：该题考查以阴阳失调所致的阴阳偏胜、阴阳偏衰、阴阳互损、阴阳格拒、阴阳离决等病机阐释寒热虚实病证、寒热真假病证、具有寒热表现的危重病证等。阴阳偏胜属“邪气胜则实”的实性病机（A对）。阴阳格拒的机理在于出现真寒假热或真热假寒的复杂病变（B错）。阴阳偏衰属“精气夺则虚”的虚性病机（C错）。阴阳互损形成阴阳两虚的病机（D错）。阴阳离决分为亡阴和亡阳两类，是具有寒热表现的危重病证（E错）。